不属于T细胞-APC识别刺激信号的黏附分子是
A. CD4-MHCⅡ类分子
B. CD8-MHCⅠ类分子
C. CD19/CD21/CD81复合体-C3d
D. CD28-CD80/CD86
E. LFA1-ICAM 1

正确答案：C。CD19/CD21/CD81复合体-C3d